关于液体药剂特点的说法，错误的是
A. 分散度大，吸收快
B. 给药途径广泛，可内服也可外用
C. 易引起药物的化学降解
D. 携带，运输方便
E. 易霉变，常需加入防腐剂

正确答案：D。携带，运输方便

解析：本题考查液体制剂的特点。液体制剂的特点：（1）药物以分子或微粒状态分散在介质中，分散程度高，吸收快，作用较迅速（A对）；（2）给药途径广，可内服也可外用（B对）；（3）药物分散程度大，易引起药物的化学降解，从而导致失效（C对）；（4）液体制剂体积较大，携带运输不方便（D错，为本题正确答案）；（5）水溶性制剂容易霉变，故常需加入防腐剂（E对）。